亚硝胺在体内合成的主要部位是
A. 口腔
B. 胃
C. 肠道
D. 膀胱
E. 食管

正确答案：B。胃